患者，女，23岁。被人发现时呈昏迷状态。查体：神志不清，两侧瞳孔呈针尖样大小；呼吸有大蒜臭味。应首先考虑的是
A. 急性安眠药物中毒
B. 急性毒蕈中毒
C. 急性有机磷农药中毒
D. 亚硝酸盐中毒
E. 一氧化碳中毒

正确答案：C。急性有机磷农药中毒

解析：有机磷酸酯类急性中毒主要表现为对胆碱能神经突触、神经肌肉接头和中枢神经系统的影响，症状表现多样。有机磷酸酯类中毒①M样症状：瞳孔缩小，视力模糊，流涎、出汗，重者口吐白沫，大汗淋漓。支气管平滑肌痉挛和腺体分泌增加而引起呼吸困难，甚至肺水肿，出现恶心、呕吐、腹痛、腹泻等胃肠道症状，小便失禁，心动过缓，血压下降②N样作用：心动过速，血压先升高后下降，肌束颤动，严重者呼吸肌麻痹而死亡③中枢神经系统表现为昏迷、血压下降等。另外特殊气味如呼吸有大蒜臭味可直接诊断为有机磷中毒（C对）。